有关舌下阜正确的是
A. 是下颌下腺导管的开口
B. 只是舌下腺导管的开口
C. 也有腮腺导管的开口
D. 是下颌下腺和舌下腺大管的开口
E. 是下颌下腺、舌下腺大管和腮腺小管的共同开口

正确答案：D。是下颌下腺和舌下腺大管的开口

解析：舌下阜上有下颌下腺管和舌下腺大管的开口(AB错D对)，腮腺导管开口在平对上颌第2磨牙牙冠颊粘膜处的腮腺管乳头(CE错)。